以下毒物除哪一种外易引起化学性肺水肿
A. 四氯化碳
B. 光气
C. 氯气
D. 氮氧化物
E. 氨

正确答案：A。四氯化碳

解析：本题考查易引起化学性肺水肿的毒物。化学性肺水肿是由于刺激性气体的化学刺激作用所引起的肺水肿。容易引起化学性肺水肿的毒物有光气（B对）、氯气（C对）、氮氧化物（D对）、氨（E对）、羰基镍、氯化苦、溴甲烷、丙烯醛等刺激性气体及某些有机磷农药。四氯化碳（A错，为本题正确答案）不易引起化学性肺水肿。